与妊娠期龈炎关系最密切的龈下优势菌为
A. 中间普氏菌
B. 伴放线聚集杆菌
C. 牙龈卟啉单胞菌
D. 螺旋体
E. 梭形杆菌

正确答案：A。中间普氏菌

解析：本题考查妊娠期龈炎。妊娠期龈炎患者龈下菌斑中细菌的组成也发生了变化，中间普氏菌（A对）明显增多而成为龈下优势菌，该菌的数量、比例及妊娠期龈炎的临床症状随妊娠月份及血中黄体酮水平的升高而变化；分娩后，中间普氏菌的数量降至妊娠前水平，临床症状也随之减轻或消失。有学者认为黄体酮在牙龈局部的增多，为中间普氏菌的生长提供了丰富的营养物质。